广东凉茶的功能有
A. 理气
B. 清热
C. 解暑
D. 祛湿
E. 生津

正确答案：B、C、D、E。清热；解暑；祛湿；生津

解析：本题考查的是广东凉茶的功能。广东凉茶的功能有清热（B对）、解暑（C对）、祛湿（D对）、生津（E对）。广东凉茶【功能】清热解暑、去湿生津。用于治疗四时感冒，发热喉痛，湿热积滞，口干尿黄。